某女，70岁。夏日中暑，症见头晕身热、四肢倦怠、咽干口渴、自汗心烦。宜选用的成药是
A. 六合定中丸
B. 清暑益气丸
C. 紫金锭
D. 十滴水
E. 六一散

正确答案：B。清暑益气丸

解析：本题考查的是清暑益气丸的主治。夏日中暑，症见头晕身热、四肢倦怠、咽干口渴、自汗心烦。宜选用的成药是清暑益气丸（B对）。清暑益气丸：【主治】中暑受热，气津两伤，症见头晕身热、四肢倦怠、自汗心烦、咽干口渴。六合定中丸（A错）：【主治】夏伤暑湿，宿食停滞，寒热头痛，胸闷恶心，吐泻腹痛。紫金锭（C错）：【主治】中暑，脘腹胀痛，恶心呕吐，痢疾泄泻，小儿痰厥；外治疔疮疖肿，痄腮，丹毒，喉风。十滴水（D错）：【主治】中暑，症见头晕、恶心、腹痛、胃肠不适。六一散（E错）：【主治】感受暑湿所致的发热、身倦、口渴、泄泻、小便黄少；外用治痱子。